与阿托品比较，东莨菪碱的特点是
A. 中枢镇静作用较强
B. 对有机磷中毒解救作用强
C. 对眼的作用强
D. 对胃肠道平滑肌作用强
E. 对心脏作用强

正确答案：A。中枢镇静作用较强

解析：本题考查东莨菪碱。东莨菪碱的醇部分在6，7位间比阿托品多一个β-取向的氧桥基团，脂溶性增强，易于进入中枢，中枢镇静作用强（A对）。大剂量阿托品可以扩瞳，解救有机磷中毒（B错）。阿托品与东莨菪碱对眼的作用不同，阿托品用于扩瞳，东莨菪碱用于散瞳（C错）。阿托品对胃肠道平滑肌（D错）、心脏（E错）的作用更强。